成人头面颈部和双上肢全部烧伤。面积为
A. 27%
B. 26%
C. 30%
D. 36%
E. 21%

正确答案：A。27%

解析：本题考查烧伤面积的估算。成人头面颈部和双上肢全部烧伤。面积为0.27（A对）。头颈占1✕9%，双上肢占2✕9%，因此本题干中烧伤面积为1✕9%+2✕9%=27%。